固体分散体中最常用的亲水性载体材料是
A. 乙基纤维素
B. 聚乙二醇类
C. Ⅱ号丙烯酸树脂
D. Ⅲ号丙烯酸树脂
E. 醋酸纤维素酞酸酯

正确答案：B。聚乙二醇类